某女，4岁。壮热烦躁，面红，大汗出，口渴喜冷饮，尿少色黄便秘；舌红，苔黄，脉数。该患儿体温进一步升高，出现手足厥冷，脉沉伏有力。根据中医理论，分析其病机是
A. 阴胜则寒
B. 阴盛格阳
C. 阳虚则寒
D. 阳盛格阴
E. 阳气亡失

正确答案：D。阳盛格阴

解析：本题考查的是阴阳格拒。某女，4岁。壮热烦躁，面红，大汗出，口渴喜冷饮，尿少色黄便秘；舌红，苔黄，脉数。该患儿体温进一步升高，出现手足厥冷，脉沉伏有力。根据中医理论，分析其病机是阳盛格阴（D对）。阴阳格拒：阴阳格拒，是阴阳失调病机中比较特殊的一类病机。形成阴阳相互格拒的机制，主要是在病变过程中阴或阳的一方偏盛至极，或阴和阳的一方极端虚弱，双方盛衰悬殊，盛者壅遏于内，将虚弱、不足的一方排斥格拒于外，迫使阴阳之间不相维系，从而出现真寒假热或真热假寒的复杂病变现象，即阴阳格拒。（1）阴盛格阳（B错）：阴盛格阳，是指阴寒之邪壅盛于内，逼迫阳气浮越于外，使阴阳之气不相顺接、相互格拒，表现为真寒假热的病机变化。病变本质是阴寒内盛，临床可见四肢厥逆、下利清谷、脉微欲绝等症状；又可见阳浮于外，症见身热反不恶寒（但欲盖衣被）、面颊泛红等假热之象。（2）阳盛格阴：阳盛格阴，是指邪热过盛，深伏于里，阳气被遏，郁闭于内，不能外透布达于肢体，从而形成阴阳排斥，而格阴于外，表现为真热假寒的病机变化。病变本质是阳热内盛，临床可见身热、面红、气粗、烦躁等症状；又突然出现四肢厥冷（但身热不恶寒）、脉象沉伏（但沉数有力）等假寒之象。阴胜则寒（A错）为阴盛。阴盛：又称“阴偏盛”，是指机体在疾病过程中所出现的一种阴邪偏盛、功能障碍或减退、产热不足，以及病变性代谢产物积聚的病机变化。阴是以寒、静、湿为其特点，阴偏盛，就出现寒象，所以说“阴胜则寒”。如形寒、肢冷、舌淡等，即是阴偏胜的具体表现。阳虚则寒（C错）为阳虚。阳虚：又称“阳偏衰”，是指机体阳气虚损、功能减退或衰弱、热量不足的病机变化。阳气不足，一般以脾肾之阳虚为主，其中尤以肾阳为诸阳之本，所以，肾阳虚衰（命门之火不足）在阳偏衰的病机中占有极其重要的地位。阳虚则不能制阴，阳气的温煦功能减弱，经络、脏腑等组织器官的某些功能活动也因之而减退，血和津液的运行迟缓，水液不化而阴寒内盛，这就是阳虚则寒的主要机制。阳虚则寒，不但可见到面色白、畏寒肢冷、舌淡、脉迟等寒象，而且还有喜静踡卧、小便清长、下利清谷等虚象。阳气亡失（E错）为亡阳。亡阳：亡阳，是指机体的阳气发生突然性脱失，而致全身功能突然严重衰竭的病机变化。多由于外邪过盛，正不敌邪，阳气突然大量耗伤而脱失；或因素体阳虚，正气不足，又因疲劳过度等多种因索而诱发；或过用汗法，汗出过多，阳随津泄，阳气骤虚而外脱等所致；而慢性消耗性疾病之亡阳，则多由阳气严重耗散而衰竭，虚阳外越所致。临床表现可见冷汗淋漓、肌肤手足逆冷、精神疲惫、神情淡漠，甚则见昏迷、脉微欲绝等症状。